属于骨折晚期并发症的是
A. 休克
B. 骨化性肌炎
C. 感染
D. 脂肪栓塞
E. 神经损伤

正确答案：B。骨化性肌炎

解析：骨折晚期并发症包括坠积性肺炎、骨化性肌炎（B对）、感染（C对）、压疮、下肢深静脉血栓形成、创伤性骨关节炎、关节僵硬、急性骨萎缩、缺血性骨坏死、缺血性肌挛缩等。休克（A错）、脂肪栓塞（D错）、神经损伤（E错）、骨筋膜室综合征等均为骨折的早期并发症。依据八版外科学教材，骨化性肌炎和感染均为骨折晚期并发症，故B、C均为正确选项。但参考答案给的是B。